血清总胆红素、结合胆红素、非结合胆红素均中度増加，可见于
A. 蚕豆病
B. 胆石症
C. 珠蛋白生成障碍性贫血
D. 急性黄疸性肝炎
E. 胰头癌

正确答案：D。急性黄疸性肝炎

解析：临床上可根据总胆红素、结合胆红素与非结合胆红素升高的程度来判断黄疽类型。与葡萄糖醛酸结合的胆红素称为结合胆红素，未与葡萄糖醛酸结合的胆红素称为非结合胆红素。血清总胆红素、结合胆红素、非结合胆红素均中度増加为肝细胞性黄疸，如急性黄疸性肝炎（D对）。若总胆红素增高伴非结合胆红素明显增高提示为溶血性黄疽，比如蚕豆病（A错）、珠蛋白生成障碍性贫血（C错）。总胆红素增高伴结合胆红素明显升高为胆汁淤积性黄疸，如胆石症（B错）、胰头癌（E错）。